下述关于颞下间隙的叙述中哪项是错误的
A. 该间隙处于颌面深部诸间隙的中央
B. 位于翼颌间隙的上方
C. 前界上颌骨的后面，后界茎突及茎突诸肌
D. 上界蝶骨大翼的颞下面、颞下嵴，内界蝶骨翼内侧板
E. 间隙中有翼丛、上颌动脉及上、下颌神经的分支通过

正确答案：D。上界蝶骨大翼的颞下面、颞下嵴，内界蝶骨翼内侧板

解析：颞下间隙位置深在，位于颅中窝底，在翼下颌间隙上方。前界为上颌骨后面，后界为茎突及茎突诸肌（C对），内界为蝶骨翼突外侧板（D错，为本题正确答案），外界为下颌支上份及颧弓，上界为蝶骨大翼的颞下面和颞下嵴，下以翼外肌下缘平面为界。特点为颞下间隙处于颌面深部诸间隙的中央，间隙中央有翼丛、上颌动脉及其分支和上、下颌神经的分支通过。掌握“面侧深区及颌面部各间隙的境界”知识点。